片剂的填充剂是
A. 聚乙烯吡咯烷酮溶液
B. L-羟丙基纤维素
C. 乳糖
D. 乙醇
E. 聚乙二醇6000

正确答案：C。乳糖

解析：本题考查片剂的常用辅料。片剂常用的稀释剂有淀粉、蔗糖、糊精、乳糖（C对）、预胶化淀粉、微晶纤维素、无机盐类和糖醇类。聚乙烯吡咯烷酮溶液（A错）常用作片剂的黏合剂。低取代羟丙基纤维素（L-HPC）（B错）常用作片剂的崩解剂。乙醇（D错）常用作片剂的润湿剂。聚乙二醇6000（E错）常作为润滑剂、分散剂、赋形剂等。